含水合型鞣质的五倍子、地榆等中药与无味红霉素联用会
A. 产生络合物，妨碍吸收
B. 增强毒性
C. 产生沉淀，降低疗效
D. 抑制药物活性
E. 引发药源性肝病

正确答案：E。引发药源性肝病

解析：本题考查的是中西药不合理联用的例举。含水合型鞣质的五倍子、地榆等中药与无味红霉素联用会引发药源性肝病（E对）。含水合型鞣质而对肝脏有一定毒性的诃子、五倍子、地榆、四季青等，以及含有这些药物的中成药，不能与对肝脏有一定毒性的西药四环素、利福平、氯丙嗪、异烟肼、依托红霉素等联用，因联用后会加重对肝脏的毒性，导致药源性肝病的发生。产生络合物，妨碍吸收（A错）为含钙、镁、铁等金属离子的中药与四环素类抗生素或左旋多巴联用的不良反应。含钙、镁、铁等金属离子的中药，如石膏、瓦楞子、牡蛎、龙骨、海螵蛸、石决明、赭石、明矾等及其中成药不能与四环素类抗生素或左旋多巴联用，因四环素类抗生素可与金属离子形成络合物，而不易被胃肠道吸收，降低疗效；左旋多巴中有游离酚羟基，遇金属离子则会产生络合反应，生成左旋多巴与钙、铝、镁、铁、铋的络合物，影响其吸收，从而降低左旋多巴的生物效应。增强毒性（B错）为含钙较多的中药或中成药与洋地黄类药物联用的不良反应。含钙较多的中药或中成药，如石膏、龙骨、牡蛎、珍珠、蛤壳及瓦楞子等，不可与洋地黄类药物合用，因钙离子为应激性离子，能增强心肌收缩力，抑制Na⁺，K⁺-ATP酶活性（也可以说与强心苷有协同作用），从而增强洋地黄类药物的作用和毒性。产生沉淀，降低疗效（C错）为含鞣质较多的中药或中成药与米痛（去痛片）、酚氨咖敏片（克感敏）、酚氨咖敏颗粒等或含金属离子的西药联用的不良反应。含鞣质较多的中药或中成药，不可与索米痛（去痛片）、酚氨咖敏片（克感敏）、酚氨咖敏颗粒等同服，因同服后可产生沉淀而不易被机体吸收。亦不可与含金属离子的西药如钙剂、铁剂、氯化钴合用，因同服后可在回盲部结合，生成沉淀，致使机体难于吸收而降低药效。抑制药物活性（D错）为金银花、连翘、黄芩、鱼腥草等及其中成药与菌类制剂联用的不良反应。金银花、连翘、黄芩、鱼腥草等及其中成药，不宜与菌类制剂如乳酶生、促菌生等联用，因金银花、连翘、黄芩、鱼腥草等及其中成药具有较强抗菌作用，服用后在抗菌的同时，还能抑制或降低西药菌类制剂的活性。